口底囊肿囊腔内充满白色豆腐渣样物质，镜下见角化覆层鳞状上皮衬里，囊壁内含有皮肤附属器。最可能的病理诊断是
A. 表皮样囊肿
B. 皮样囊肿
C. 畸胎样囊肿
D. 口底囊肿
E. 蛤蟆肿

正确答案：B。皮样囊肿

解析：本题考查皮样囊肿。皮样囊肿和表皮样囊肿囊腔内均可见白色豆腐渣样物质，镜下见角化复层鳞状上皮衬里。若囊壁内没有皮肤附属器，则为表皮样囊肿（A错）；若囊壁内含有皮肤附属器，则为皮样囊肿（B对），如毛发、毛囊、皮脂腺、汗腺等结构。畸胎样囊肿（C错）是罕见发育性囊肿，最常见于舌体部，其次是口底部，颈部少见，组织学上囊肿衬里上皮主要为复层鳞状上皮，部分上皮为胃肠道黏膜上皮，类似于胃体和胃底黏膜。口底囊肿（D错）是在临床上尚未做出明确诊断的发生于口底的囊肿，不是病理诊断的范畴。蛤蟆肿（E错）即舌下囊肿，多数为外渗性囊肿，无上皮衬里，少数潴留囊肿内衬立方状、柱状、假复层柱状或复层鳞状上皮。